女童，7岁，乳牙龋坏较多，已充填。六龄牙已萌齐，医生诊断16（牙合）面中龋，采用龋非创伤性充填（ART）治疗该牙应用处理剂清洁制备完成的窝洞，处理剂一般使用
A. 5%磷酸
B. 10%磷酸
C. 30%～40%磷酸
D. 10%聚丙烯酸
E. 20%聚丙烯酸

正确答案：D。10%聚丙烯酸

解析：本题考查非创伤性修复治疗。用处理剂清洁窝洞以促进玻璃离子材料与牙面的化学性黏结。处理剂一般为弱聚丙烯酸（10%）（D对）。用小棉球或小海棉球蘸一滴涂布全部窝洞10秒，立即冲洗两次。如窝洞被血及唾液污染，及时止血，冲洗并干燥，用于棉卷隔湿再涂处理剂。